可能导致儿童牙釉质发育不良的药品是
A. 氟喹诺酮类抗菌药
B. 四环素类抗生素
C. 氨基糖苷类抗生素
D. 硝基呋喃类抗菌药
E. 磺胺类抗菌药

正确答案：B。四环素类抗生素

解析：本题考查儿童用药。可能导致儿童牙釉质发育不良的药品是四环素（B对）。四环素与钙盐形成络合物，伴随钙盐沉积于牙齿及骨骼中，致使儿童牙齿黄染，影响骨质发育。某些药物如喹诺酮类抗菌药物（A错）可引起关节痛、关节肿胀及软骨损害，影响骨骼发育。氨基糖苷类抗生素（C错）可引起第Ⅷ对脑神经损伤。某些药物与新生儿血浆蛋白结合能力强，如磺胺类药（E错）、吲哚美辛等可与血胆红素竞争血浆蛋白，故新生儿应用磺胺类药物后可使血中游离胆红素浓度增高，而新生儿血-脑屏障尚未完全形成，胆红素易进入脑细胞内，引发新生儿胆红素脑病，严重者导致死亡。